个体经验的获得而引起行为发生相对稳定变化的过程称为
A. 记忆
B. 感觉
C. 学习
D. 知觉
E. 思维

正确答案：C。学习

解析：学习是个体经验的获得而引起行为发生相对稳定变化的过程（C对）。记忆（A错）是指在头脑中积累和保持个体经验的心理过程。从信息加工的观点看，记忆是人脑对外界输人的信息进行编码、储存和提取的过程。感觉（B错）是人脑对直接作用于感觉器官的客观事物的个别属性的反映，是最基本的认知过程。知觉（D错）是人脑对直接作用于感觉器官的客观事物的整体属性的反映，它是一系列组织并解释外界客体和事件产生的感觉信息的加工过程。思维（E错）是人脑间接地概括地对客观事物的反映。